治疮疡肿毒、咽喉肿痛、口舌生疮的药物是
A. 朱砂
B. 磁石
C. 两者均是
D. 两者均不是

正确答案：A。朱砂

解析：本题考查的是朱砂的主治病证。治疮疡肿毒、咽喉肿痛、口舌生疮的药物是朱砂（A对）。朱砂：【主治病证】（1）心火亢盛之心神不安、胸中烦热、惊悸不眠，癫狂，癫痫。（2）疮疡，咽痛，口疮。磁石（B错）：【主治病证】（1）心神不宁，心悸失眠，惊风癫痫。（2）肝阳上亢，头晕目眩。（3）耳鸣，耳聋，目昏。（4）肾虚喘促。